主要靠增加组织中cAMP而发挥作用的药物是
A. β受体激动剂
B. 白三烯受体拮抗剂
C. 抗过敏药
D. 肾上腺皮质激素
E. 抗胆碱药

正确答案：A。β受体激动剂

解析：本题考查药物的作用机制。主要靠增加组织中cAMP而发挥作用的药物是β受体激动剂（A对）。β受体激动剂通过激动呼吸道的β₂受体激活腺苷酸环化酶，使细胞内的环磷酸腺苷含量增加，进而松弛支气管平滑肌。白三烯受体阻断剂（B错）通过有效地抑制白三烯与受体结合，预防白三烯引起的血管通透性增加、气道水肿和支气管平滑肌的收缩，抑制嗜酸性粒细胞、淋巴细胞和组织细胞的浸润，减少因肺泡巨噬细胞刺激所产生的过氧化物，减轻气道炎症，从而缓解哮喘症状。抗过敏药（C错）能稳定致敏细胞膜，阻止组胺等多种过敏反应介质，如5-羟色胺、缓激肽等的释放。肾上腺皮质激素（D错）的药理作用：①抗炎作用；②抗过敏作用；③松弛气道平滑肌的作用；④可阻止迟发性变态反应和降低支气管的高反应性。抗胆碱药（E错）能够阻断节后迷走神经通路，降低迷走神经兴奋性而起到舒张支气管的作用，并有减少痰液分泌的作用。